测定庆大霉素含量的方法是
A. 分子排阻色谱法
B. 四氮唑比色法
C. 抗生素微生物法
D. 氧瓶燃烧比色法
E. 红外分光光度法

正确答案：C。抗生素微生物法

解析：本题考查含量测定。测定庆大霉素含量的方法是抗生素微生物法（C对）。庆大霉素为氨基糖苷类抗生素，氨基糖苷类抗生素的效价测定主要有微生物检定法（C对）和HPLC法。分子排阻色谱法（A错）可用于右旋糖酐系列制剂测定分子量与分子分布；四氮唑比色法（B错）是用于皮质激素药物含量测定的方法；氧瓶燃烧比色法（D错）适用于含卤素或硫、磷等元素的有机药物处理；红外分光光度法（E错）在杂质检查中主要用于药物中无效或低效晶形的检查。